早期牙周炎牙槽嵴吸收拍摄何种X线片
A. 根尖片
B. (牙合)翼片
C. 牙合片
D. 曲面断层片
E. CT检查

正确答案：B。(牙合)翼片

解析：本题考查早期牙周炎的影像学检查。早期牙周炎牙槽嵴吸收应拍摄（牙合）翼片（B对）。（牙合）翼片能较真实反映牙槽骨吸收程度和类型，但不能显示整个牙根及根尖周骨质情况。